颌下颈部发生急性蜂窝织炎，最危险的并发症是
A. 脓毒血症
B. 呼吸困难窒息
C. 吞咽困难
D. 化脓性颌下腺炎
E. 面部感染

正确答案：B。呼吸困难窒息

解析：颌下颈部发生急性蜂窝织炎，可发生喉头水肿和压迫气管，引起呼吸困难，甚至窒息（B对），为其最危险的并发症。脓毒血症（A对）、吞咽困难（C对）都是颌下颈部发生急性蜂窝织炎的并发症，但不是最危险的并发症。化脓性颌下腺炎系各种原因导致的导管阻塞或狭窄，引起涎液排泄不畅，口腔细菌逆行感染的结果，与颌下颈部发生急性蜂窝织炎的并发症无关（D错）。面部感染可向颌下或颈深部蔓延，引起相应并发症，本身不属于颌下颈部发生急性蜂窝织炎的并发症（E错）。